心尖搏动点位于
A. 第5肋间
B. 第5肋间锁骨中线内侧9cm
C. 左侧第6肋间锁骨中线内侧1cm
D. 第5肋间锁骨中线内侧1cm
E. 左侧第5肋间锁骨中线内侧1cm

正确答案：E。左侧第5肋间锁骨中线内侧1cm

解析：左侧第5肋间锁骨中线内侧1-2cm（E对）为心尖搏动点，心尖由左心室构成，朝向左前下方，与左胸前壁接近。